脾病及肾，体现的关系是
A. 母病及子
B. 子病及母
C. 相乘传变
D. 相侮传变
E. 母子同病

正确答案：C。相乘传变

解析：母子同病为母病及子或子病及母，母脏子脏相互影响而同病。脾属土，肾属水，土克水，脾病及肾，非母脏、子脏的关系，是相克太过导致的传变（C对）。